男，82岁，有多年冠心病病史。夜间睡觉时突发胸闷，端坐呼吸，查体：R35次/分，BP80/50mmHg，双肺可闻及湿啰音，心率102次/分。该患者最可能的诊断是
A. 慢性左心衰
B. 全心衰
C. 急性左心衰
D. 右心衰
E. 肺栓塞

正确答案：C。急性左心衰

解析：老年患者 ，冠心病病史，呼吸频率35次/分，端坐呼吸，双肺湿啰音，是急性左心衰的表现（C对）。全心衰时因右心衰竭时右心排血量减少，因此以往的阵 性呼吸困难等肺淤血症状反而有所减轻（B错）；右心衰以体循环淤血为主要表现（D错）；肺栓塞会出现细湿罗音和哮鸣音（E错）。